血小板数计数增多是指
A. 血小板数多于80×10⁹/L
B. 血小板数多于100×10⁹/L
C. 血小板数多于200×10⁹/L
D. 血小板数多于300×10⁹/L
E. 血小板数多于400×10⁹/L

正确答案：E。血小板数多于400×10⁹/L